鼻渊病人，可见的症状是
A. 鼻孔咽喉干燥
B. 鼻塞流浊涕
C. 鼻流浊涕腥臭
D. 鼻血鲜红
E. 鼻塞流清涕

正确答案：C。鼻流浊涕腥臭

解析：该题考查望诊鼻内病变，需理解记忆。